维生素B₁缺乏可引起
A. 癜皮病
B. 脚气病
C. 坏血病
D. 佝偻病
E. 干眼症

正确答案：B。脚气病